膜剂的特点有
A. 含量准确
B. 稳定性好
C. 多层膜可实现控制释药
D. 成膜材料用量大
E. 载药量少，仅适用于剂量小的药物

正确答案：A、B、C、E。含量准确；稳定性好；多层膜可实现控制释药；载药量少，仅适用于剂量小的药物